中医外科内治法中，温阳托毒法的代表方是
A. 透脓散
B. 托里消毒散
C. 神功内托散
D. 右归丸
E. 桂附八味丸

正确答案：C。神功内托散

解析：温阳托毒法属于内托法之一。内托法指用补益和透脓的药物，扶助正气，托毒外出，使疮疡毒邪移深居浅，早日液化成脓，或使病灶趋于限局化，使邪盛者不致脓毒旁窜深溃，正虚者不致毒邪内陷，从而达到脓出毒泄、肿痛消退的目的，寓有"扶正达邪"之意。内托法可分为透托法和补托法两类。其中补托法又可分为益气托毒法和温阳托毒法。神功内托散方含当归、白术、黄芪、人参、白芍、茯苓、陈皮、附子、木香、甘草（炙）、川芎、山甲（炒），可温补托里，为温阳托毒法的代表方（C对）。透脓散为透托法的代表方（A错）。托里消毒散为益气托毒法的代表方（B错）。右归丸（D错）和桂附八味丸（E错）则属于补益法的代表方剂。